属于牙膏基本成分中属于防腐剂的是
A. 洗必泰
B. 单氟磷酸钠
C. 氯化钾
D. 三氯羟苯醚
E. 氧化剂

正确答案：D。三氯羟苯醚

解析：牙膏基本成分中防腐剂作用是防止细菌生长，延长贮存期限，并使其他成分相容，常用乙醇、苯甲酸盐及二氯化酚，三氯羟苯醚（又称玉洁纯、三氯生）等。掌握“自我口腔保健方法”知识点。